有关高分子化合物，下面那项说法是不正确的
A. 分子量达几千至几百万
B. 其化学组成简单
C. 成品具有一定的毒性
D. 在医学领域广为应用
E. 成品无毒或毒性很小

正确答案：C。成品具有一定的毒性

解析：本题考查高分子化合物的理化性质。高分子化合物是指分子量高达几千至几百万（A对），化学组成简单（B对），由一种或几种单体，经聚合或缩聚而成的化合物，故又称聚合物。高分子化合物广泛应用于工业、农业、化工、建筑、通信、国防、日常生活用品等方面，也广泛应用于医学领域（D对）。高分子化合物本身无毒或毒性很小（E对），不能说明高分子化合物的成品均具有一定的毒性（C错，为本题正确答案）。